我国卫生标准中采用的最高容许浓度数值是指工人经常停留的工作地点的呼吸带
A. 粉尘浓度的日平均值
B. 任何一次采样测尘中均不应超过的粉尘浓度最高限值
C. 瞬间可超过的粉尘浓度值
D. 时间加权平均浓度
E. 粉尘浓度的年平均值

正确答案：B。任何一次采样测尘中均不应超过的粉尘浓度最高限值

解析：本题考查最高容许浓度的概念。最高容许浓度是指在一个工作日内，任何时间均不应超过的有毒化学物质的浓度（B对）。这个概念规定了一个有毒化学物质的上限值（C错），一天中任意时刻的最高值都不应超过这个浓度，与一个时间单元内的平均浓度无关（ADE错）。